18883-2002）》规定要求，室内SO₂浓度1小时均值
A. ≤10mg/m³
B. ≤0.50mg/m³
C. ≤0.24mg/m³
D. ≤0.60mg/m³
E. ≤1.0mg/m³

正确答案：B。≤0.50mg/m³

解析：本题考查我国《室内空气质量标准（GB/T 18883-2002）》规定要求的室内SO₂浓度l小时均值。我国《室内空气质量标准》（GB/T 18883-2002）规定，室内SO₂浓度1小时均值≤0.50mg/m³（B对ACDE错）。